具有肺毒性和光敏反应的抗心律失常药是
A. 普罗帕酮
B. 美西律
C. 地尔硫䓬
D. 维拉帕米
E. 胺碘酮

正确答案：E。胺碘酮

解析：本题考查胺碘酮。胺碘酮（E对）可引起肺毒性（发生率15%-20%）。此外，胺碘酮服药者常发生显著的光过敏（20%）。普罗帕酮（A错）常见的不良反应为眩晕、头痛、运动失调、口腔金属异味，可使充血性心力衰竭恶化，尤其有心力衰竭病史者。美西律（B错）常见的不良反应主要有眩晕、震颤、运动失调、语音不清、视物模糊等，与食物同服可以减轻。维拉帕米（D错）口服安全，静脉给药可引起血压下降和暂时窦性停搏。地尔硫䓬（C错）和维拉帕米相似，可产生缓慢的心律失常、低血压和肝脏转氨酶升高，此外还有皮炎、头痛和头晕的报道。